初产妇，孕37周，清晨骤醒发现躺在血中，急诊入院，查血压12/8kPa（90/60mmHg），脉搏120次/分，神清，胎心音160次/分，阴道少量活动性流血其胎方位下述哪种可能性最少
A. LOT，胎头高浮
B. ROA，先露已衔接
C. 臀位
D. 横位
E. ROP，先露未入盆

正确答案：B。ROA，先露已衔接

解析：清晨骤醒发现躺在血中，这句话提示是妊娠晚期无痛性阴道流血，诊断为前置胎盘。由于胎盘前置，故胎头一般不会衔接。掌握“前置胎盘”知识点。